临床表现为局部间断性疼痛，牙龈和周围软组织有瘘管形成，口臭明显，死骨暴露，为以下哪种疾病
A. 放射性骨髓炎
B. 结核性骨髓炎
C. 慢性局灶性硬化性骨髓炎
D. 慢性化脓性骨髓炎
E. 急性化脓性骨髓炎

正确答案：A。放射性骨髓炎

解析：放射性骨髓炎的主要临床症状表现为局部间断性疼痛，开口受限，牙龈和周围软组织发生蜂窝织炎，有瘘管形成，口臭明显，死骨暴露。掌握“结核性骨髓炎及放射性骨髓炎”知识点。